可称为低血钾的共同治疗方案的是
A. 氯化钾
B. 碳酸氢钠溶液
C. 螺内酯
D. 新斯的明
E. 肾上腺皮质激素

正确答案：A。氯化钾

解析：低血钾的治疗主要应用氯化钾（A对）。碳酸氢钠溶液（B错）主要用于治疗高钾血症和重症酸中毒。螺内酯（C错）为醛固酮的竞争性抑制剂，是一种保钾利尿剂，通常与排钾性利尿剂合用，可在利尿的同时预防低钾血症，但并不用于低钾血症的治疗。新斯的明（D错）为胆碱酯酶抑制药，主要用于治疗重症肌无力及腹部手术后的肠麻痹。肾上腺皮质激素（E错）主要用于危重病人的抢救及其他药物治疗无效的某些慢性病。